不符合《精神卫生法》规定条件的医疗机构擅自从事精神障碍诊断、治疗的，由县级以上人民政府卫生行政部门责令停止相关诊疗活动，给予警告，有违法所得的，没收违法所得，并处罚款范围为多少
A. 2000～3000
B. 3000～5000
C. 5000～10000
D. 10000～20000
E. 20000以上

正确答案：C。5000～10000

解析：不符合《精神卫生法》规定条件的医疗机构擅自从事精神障碍诊断、治疗的，由县级以上人民政府卫生行政部门责令停止相关诊疗活动，给予警告，并处5千元以上1万元以下罚款，有违法所得的，没收违法所得；对直接负责的主管人员和其他直接责任人员依法给予或者责令给予降低岗位等级或者撤职、开除的处分；对有关医务人员，吊销其执业证书。掌握“精神障碍康复及法律责任”知识点。